女，45岁。近2年月经不规律，现停经6个月，阴道不规则流血10天，无腹痛。查体：中度贫血貌，子宫及双侧附件无明显异常。首选的辅助检查方法是
A. X线检查
B. 分段刮宫
C. CT检查
D. 阴道镜检查
E. 尿hCG测定

正确答案：B。分段刮宫

解析：子宫内膜癌的常见临床表现为绝经过渡期月经紊乱，阴道不规则流血，可伴有腹痛，可出现贫血，根据患者的临床表现和实验室检查，最可能的诊断是子宫内膜癌。活组织检查是确诊子宫内膜癌的金标准，因此刮宫（B对）是首选的辅助检查方法。X线检查（A错）对诊断子宫内膜癌无效。CT检查（C错）能排除子宫占位性病变，仅作为子宫内膜癌的诊断依据，但不能确诊。阴道镜检查（D错）对诊断子宫颈癌有重要意义，对子宫内膜癌的诊断意义不大。尿hCG测定（E错）对早期妊娠诊断有重要意义，对与妊娠相关疾病、滋养细胞肿瘤等疾病的诊断、鉴别和病程观察等有一定价值，但对诊断子宫内膜癌无意义。